下列关于普萘洛尔抗心律失常的描述，错误的是
A. 降低窦房结的自律性
B. 治疗量延长浦氏纤维的APD和ERP
C. 减慢房室传导
D. 治疗量延长房室结的APD和ERP
E. 阻断心脏的β受体

正确答案：B。治疗量延长浦氏纤维的APD和ERP

解析：本题考查普萘洛尔抗心律失常。治疗量延长浦氏纤维的APD和ERP（B错，为本题的正确答案）可见于阿替洛尔。普萘洛尔为β肾上腺素受体拮抗剂，可通过阻断心脏的β受体（E对），降低窦房结、心房和浦肯野纤维自律性（A对），减少儿茶酚胺所致的迟后除极发生，减慢房室结传导（C对），延长房室交界细胞的绝对不应期（APD）和有效不应期（ERP）（D对）。